某女患者，59岁，因患肝硬，化腹水，出现肝性脑病，多次昏迷，处于濒死状态。其子在得知母亲已治愈无望时，向主管医师提出书面请求：为其母实施“安乐死”，以尽快解除病人濒死前的剧痛。在家属再三请求之下，主管医师下了医嘱，先后两次注射复方冬眠灵175mg,病人安静地死去。之后，主管医师及病人的儿子2人均以故意杀人罪被起诉立案，后经市人民法院多次公开审理及诉讼后，才宣告主管医师无罪释放。从医学伦理方面对该医师所作所为的正确评价是
A. 完全正确，其选择在医学上有充分依据
B. 完全错误，医师实行安乐死与杀人无异
C. 法律允许，但在伦理上是成问题的
D. 法律允许，在伦理上也是说得通的
E. 没有处理好医学决策与伦理判断之间的矛盾，是有着严重的伦理问题的

正确答案：E。没有处理好医学决策与伦理判断之间的矛盾，是有着严重的伦理问题的